下列属于酰基辅酶A胆固醇酰基转移酶抑制药的是
A. 甲亚油酰胺
B. 烟酸
C. 考来替泊
D. 辛伐他汀
E. 维生素E

正确答案：A。甲亚油酰胺